检查某药物中的氯化物，称取供试品0.50g，依法检查，与标准氯化钠溶液（0.01mgCl⁻/ml）5ml制成的对照液比较，不得更浓，则氯化物的限量为
A. 1.0E-5
B. 5.0E-5
C. 0.0001
D. 0.0005
E. 0.001

正确答案：C。0.0001